长期应用氯丙嗪，最常见的副作用是
A. 体位性低血压
B. 过敏反应
C. 锥体外系反应
D. 内分泌障碍
E. 消化系症状

正确答案：C。锥体外系反应